方某，46岁。头痛眩晕，甚则欲仆，胸闷呕恶，苔白腻，脉弦滑，治宜用
A. 镇肝熄风汤
B. 川芎茶调散
C. 龙胆泻肝汤
D. 半夏白术天麻汤
E. 补中益气汤

正确答案：D。半夏白术天麻汤

解析：“头痛眩晕，甚则欲仆，胸闷呕恶，苔白腻，脉弦滑”提示内有风痰，当治以化痰息风，健脾祛湿，方选半夏白术天麻汤（D对）--方中半夏燥湿化痰，降逆止呕；天麻平肝熄风，而止头眩，两者合用，为治风痰眩晕头痛之要药，以两味为君药。以白术、茯苓为臣，健脾祛湿，能治生痰之源。佐以橘红理气化痰，俾气顺则痰消。使以甘草和中调药；煎加姜、枣调和脾胃，生姜兼制半夏之毒。镇肝息风汤功用为镇肝息风，滋阴潜阳，主治类中风（A错）。川芎茶调散功用为疏风止痛，主治外感风邪头痛（B错）。龙胆泻肝汤功用为主治清泻肝胆实火，清利肝经实热，主治肝胆实火上炎证；肝经湿热下注证（C错）。补中益气汤功用为补中益气，升阳举陷，主治脾胃气虚证（E错）。